男，38岁，上腹疼痛6年。餐前痛伴反酸，近日疼痛加重，且呈持续性向腰背部放射，有时低热。胃肠钡餐示：十二指肠球部变形。血白细胞11×10⁹/L，中性0.780。诊断首先考虑为
A. 慢性胃炎
B. 胃溃疡
C. 胃癌
D. 十二指肠穿透性溃疡
E. 胃粘膜脱垂

正确答案：D。十二指肠穿透性溃疡

解析：中年男性患者，上腹疼痛6年病史。餐前痛伴反酸（饥饿痛，提示十二指肠溃疡），近日疼痛加重，且呈持续性向腰背部放射（腹痛规律改变，变得顽固而持续），有时低热。实验室检查：外周血白细胞11×10⁹/L（正常值4～10×10⁹/L，提示存在感染）。胃肠钡餐示：十二指肠球部变形。综合该患者病史、临床表现、实验室检查、钡剂造影，该患者诊断首先考虑为十二指肠穿透性溃疡（D对）。胃溃疡（B错）表现为餐后痛，钡餐检查示胃部龛影。慢性胃炎（A错）、胃癌（C错）和胃黏膜脱垂（E错）上腹痛无节律性和周期性，且不会向腰背部放射、钡餐检查不会提示十二指肠球部变形。